检查面部左右是否对称，关节区、下颌角、下颌支和下颌体的大小和长度是否正常。属于以上哪项
A. 外形与关节动度检查
B. 咀嚼肌检查
C. 颈前三角检查
D. （牙合）关系检查
E. 下颌运动检查

正确答案：A。外形与关节动度检查

解析：外形与关节动度检查：检查面部左右是否对称，关节区、下颌角、下颌支和下颌体的大小和长度是否正常，两侧是否一致和协调，注意面部有无压痛和髁状突活动度的异常。有两种方法可检查髁状突动度的情况：以双手示指或中指分别置于两侧耳屏前（髁状突外侧），患者作张闭口运动时，感触髁状突之动度；或将两手小指伸入外耳道内，向前方触诊，以了解髁状突之活动及冲击感，协助关节疾病的诊断。此外，还应检查颏部中点是否居中，颜面下1/3部分有无明显增长或缩短。掌握“口外一般检查及辅助检查”知识点。